4-苯基哌啶类镇痛药物是
A. 吗啡
B. 盐酸哌替啶
C. 盐酸曲马多
D. 盐酸美沙酮
E. 酒石酸布托啡诺

正确答案：B。盐酸哌替啶

解析：本题考查镇痛药物的结构特点。盐酸哌替啶（B对）属于4-苯基哌啶类结构的镇痛药，其结构可以看作仅保留吗啡A环和E环的类似物。